对某地30万人进行某病普查，共查出该病病例90人，因此得出
A. 某地某病发病率为30/10万
B. 某地某病患病率为30/10万
C. 某地某病罹患率为30/10万
D. 某地某病续发率为30/10万
E. 某病累积发病率为30/10万

正确答案：B。某地某病患病率为30/10万

解析：本题考查患病率。患病率是指某特定时间内总人口中某病新旧病例所占的比例。某地新旧病例之和为90人，总人口为30万，即患病率为90/30万，即30/10万（B对ACDE错）。